患者，女性，22岁，4天前因劳累出现左侧下后牙龈胀痛，进食吞咽时加重，昨日起出现局部自发性跳痛，面部肿胀，张口受限，伴发热。检查：左侧颊部肿胀，局部皮温增高，压痛明显，局限于咬肌前缘处，并及凹陷性水肿；张口度约二指，左下颌第三磨牙近中低位阻生，牙龈瓣覆盖其上，充血肿胀，并见糜烂，挤压局部少量脓液溢出，同侧第一磨牙前庭沟丰满充血，压痛存在，第一磨牙叩诊（-），无松动，无龋坏，未及牙周袋。该患者最有可能的诊断是左侧第三磨牙冠周炎。该患者左颊部皮肤肿胀原因最有可能是
A. 反应性水肿
B. 颊间隙感染
C. 颌上淋巴结炎
D. 局部皮肤感染
E. 咬肌间隙感染

正确答案：B。颊间隙感染

解析：本题考查左颊部皮肤肿胀的原因。颊间隙是指位于颊部皮肤与颊黏膜之间颊肌周围的间隙，颊间隙感染表现为颊部肿胀（B对），病程进展缓慢，范围局限。变态反应性水肿（A错）一般由接触过敏原引起。局部皮肤（D错）、颊黏膜溃疡继发感染，或颊、颌上淋巴结炎症扩散（C错）也可导致颊间隙感染，引起颊部肿胀，同时伴有淋巴结肿胀、压痛。咬肌间隙感染（E错）典型症状是以下颌支及下颌角为中心的咬肌区肿胀、变硬、压痛伴明显张口受限，咬肌肥厚坚实，一般不易触到波动感。